患者，男，7岁。右下后牙菜花样溃疡2个月，溃疡约2.8cm×3cm大小，临近溃疡的牙齿略松动，右颈上部触及一淋巴结，约1.5cm×2.0cm大小，质偏硬、尚可活动，未发现远处转移。对该患者局部应做的检查是
A. CT
B. B超
C. X线片
D. 核素骨扫描
E. 穿刺

正确答案：C。X线片

解析：牙龈癌需要做口腔X线检查以确定牙龈癌侵犯的范围，是否有周围组织浸润，需要常规拍摄X线片，所以C正确。掌握“鳞状细胞癌概述及舌癌、牙龈癌”知识点。